既强筋壮骨，又和胃健脾的中成药是
A. 龙牡壮骨颗粒
B. 小儿健胃糖浆
C. 小儿胃宝丸
D. 小儿消食片
E. 婴儿健脾口服液

正确答案：A。龙牡壮骨颗粒

解析：本题考查的是龙牡壮骨颗粒的功能。既强筋壮骨，又和胃健脾的中成药是龙牡壮骨颗粒（A对）。龙牡壮骨颗粒：【功能】强筋壮骨，和胃健脾。小儿消食片（D错）：【功能】消食化滞，健脾和胃。小儿健胃糖浆（B错）、小儿胃宝丸（C错）与婴儿健脾口服液（E错）的功能，2022年考试指南未明确说明。